女性，30岁，背部肿块，红、肿、疼痛3天，寒战、发热39℃，查体：背部肿物3cm×5cm，触之有波动感。根据临床特点，该患者有脓血症征象，其主要特点是
A. 寒战后，高热呈稽留热
B. 白细胞计数30×109/L
C. 休克出现早
D. 肝、肾功能损害
E. 转移性脓肿

正确答案：E。转移性脓肿

解析：患者出现脓血症征象，表明患者在体内形成转移性脓肿。掌握“外科感染”知识点。